患者，女，36岁，已婚。经行时肢体疼痛麻木，肢软无力，月经量少，色淡质薄，面色无华，舌淡，苔白，脉细弱。治疗应首选
A. 八珍汤
B. 当归补血汤
C. 血府逐瘀汤
D. 趁痛丸
E. 圣愈汤

正确答案：B。当归补血汤

解析：题中患者经行时肢体疼痛麻木，故诊断为经行身痛。血虚不能濡养筋脉，经行时气血益感不足，四肢百骸失于荣养，故肢体麻木疼痛；血虚冲任血海不足，故月经量少，色淡质薄；血虚气弱，故肢软无力，面色无华；舌淡，苔白，脉细弱为气血虚弱之象，故辨为血虚证。治宜养血益气，柔筋止痛。八珍汤功能益气补血，主治气血两虚证，临床应用以气短乏力，心悸眩晕，舌淡，脉细无力为辨证要点（A错）。题中患者诊断为经行身痛血虚证，治宜养血益气，柔筋止痛，方选当归补血汤（B对）。血府逐瘀汤功能活血化瘀，行气止痛，主治胸中血瘀证（C错）。趁痛丸为经行身痛血瘀证的选方，功能活血通络，益气散寒止痛（D错）。圣愈汤功能补气、补血、摄血，主治气血虚弱，气不摄血证，月经量多（E错）。